新生儿寒冷损伤综合征重度低温患儿复温时间是
A. 立即
B. 6小时内
C. 6～12小时
D. 12～24小时
E. 24～48小时

正确答案：D。12～24小时

解析：新生儿寒冷损伤综合征重度低温患儿应在12～24小时（D对）恢复正常体温。轻中度低温患儿可置于中性温度的暖箱中，一般在6～12小时（C错）内可恢复正常体温。